甘草使用注意有
A. 不宜大量久服
B. 湿盛中满者不宜服
C. 脾虚食少者不宜服
D. 脘腹挛急疼痛不宜服
E. 不宜与甘遂、芫花、大戟同用

正确答案：A、B、E。不宜大量久服；湿盛中满者不宜服；不宜与甘遂、芫花、大戟同用

解析：本题考查的是甘草的使用注意。甘草使用注意有不宜大量久服（A对）、湿盛中满者不宜服（B对）与不宜与甘遂、芫花、大戟同用（E对）。甘草：【主治病证】（1）心气虚之心动悸、脉结代。（2）脾虚乏力、食少便溏（C错）。（3）咳嗽气喘。（4）疮痈肿毒，食物或药物中毒。（5）脘腹或四肢挛急疼痛（D错）。（6）调和诸药。【使用注意】本品味甘，易助湿壅气，故湿盛中满者不宜服。反大戟、甘遂、芫花、海藻，均忌同用。大剂量服用甘草，易引起浮肿，故不宜大量久服。